胞质内含有酶原颗粒的细胞是
A. 浆液细胞
B. 黏液细胞
C. 闰管细胞
D. 分泌管细胞
E. 肌上皮细胞

正确答案：A。浆液细胞

解析：浆液性腺泡：呈球形，由浆液细胞组成，细胞呈锥体形，基底部较宽，紧附于基底膜上，顶端向着腔内。胞核为圆形，位于基底部1/3处。胞质色深，组织固定好时，顶端胞质内可见大量折光性很强的分泌颗粒，称酶原颗粒。浆液细胞主要表达α-淀粉酶。掌握“唾液腺组织结构”知识点。